左心衰竭首先引起的病变是
A. 槟榔肝
B. “海蛇头”样形态
C. 脾淤血、肿大
D. 脑淤血、水肿
E. 肺淤血、水肿

正确答案：E。肺淤血、水肿

解析：左心衰竭时，左心室的射血功能障碍，血液滞留于左心室，导致室内压增高，进而使左心房内压也升高，阻碍肺静脉的回流，首先引起肺淤血、水肿（E对）。槟榔肝（P46）（A错）常见于慢性肝淤血，是指肝小叶中央区因严重淤血呈暗红色，而肝小叶周边部肝细胞则因脂肪变性呈黄色，致使肝的切面上出现红、黄相间的条纹，状似槟榔切面。“海蛇头”样形态（B错）是腹壁静脉曲张的特有表现，它和脾淤血、肿大（C错）均可见于肝硬化门脉高压症（P202）中。脑淤血，水肿（D错）常见于高血压的脑病变（P142）中。